“气之根”指的是
A. 脾
B. 心
C. 肺
D. 肝
E. 肾

正确答案：E。肾

解析：本题考查肺与肾在呼吸运动中的作用，属于理解记忆内容。肺主气而司呼吸，肾藏精而主纳气。人体的呼吸运动，虽由肺所主，但亦需肾的纳气功能协助。只有肾精及肾气充盛，封藏功能正常，肺吸入的清气才能经过其肃降而下纳于肾，以维持呼吸的深度。可见，在人体呼吸运动中，肺气肃降，有利于肾的纳气；肾精肾气充足，纳摄有权，也有利肺气之肃降。故云“肺为气之主，肾为气之根（E对）”（《景岳全书·杂证谟》）。